生产品红的工人中好发
A. 肝癌
B. 膀胱癌
C. 结肠癌
D. 皮肤癌
E. 肺癌

正确答案：B。膀胱癌

解析：本题考查品红所导致的癌症类型。实验证明品红工人因为需要长期接触苯胺，苯胺的致癌部位为膀胱，从而导致品红工人膀胱癌（B对ACDE错）高发。